腹外疝最易嵌顿的是
A. 斜疝
B. 直疝
C. 股疝
D. 切口疝
E. 脐疝

正确答案：C。股疝

解析：疝囊通过股环、经股管突出的疝称为股疝。由于股管几乎是垂直的，疝块在卵圆窝处向前转折时形成一锐角，且股环本身较小，周围又多坚韧的韧带，因此股疝容易嵌顿。腹外疝最易发生嵌顿的是股疝（C对），约占所有嵌顿疝的60%，其次为斜疝（A错）。直疝（B错）、切口疝（D错）、脐疝（E错）均很少发生嵌顿。